最易并发维生素A缺乏症的是
A. 幼儿急疹
B. 麻疹
C. 川畸病
D. 风疹
E. 咽结合膜热

正确答案：B。麻疹

解析：麻疹患儿的临床表现较严重，会有高热，食欲不振等，易引起营养不良以及维生素A缺乏症（B对）。幼儿急疹（A错）、风疹（D错）和咽结合膜热（E错）的症状很轻，病程很短，很少发生营养不良的并发症。川畸病又叫皮肤黏膜淋巴结综合征，表现为皮疹、黏膜水肿、淋巴结肿大，很少有并发症（C错）。